与宫颈癌发生密切相关的是
A. 人乳头瘤病毒
B. 麻疹病毒
C. 禽流感病毒
D. 乙肝病毒
E. 以上都不正确

正确答案：A。人乳头瘤病毒

解析：与宫颈癌发生密切相关的是人乳头瘤病毒（A对）。麻疹病毒（B错）与麻疹密切相关。禽流感病毒（C错）与非典型肺炎相关。乙肝病毒（D错）与乙型肝炎、肝硬化和肝癌相关。